中药在贮藏过程中，由于受到诸多因素的影响，其质量也会不断发生变化。对中药质量变异有影响的自身因素是
A. 水分、虫害、油脂
B. 油脂、淀粉、色素
C. 日光、淀粉、色素
D. 虫害、霉菌、容器
E. 空气、水分、包装

正确答案：B。油脂、淀粉、色素

解析：本题考查的是自身因素对中药质量变异的影响。包括水分、淀粉、粘液质、油脂、挥发油、色素等（B对）。自身因素对中药质量变异的影响：1.水分；2.淀粉；3.黏液质；4.油脂；5.挥发油；6.色素；7.鞣质；8.无机化合物；9.树脂。影响中药质量变异的环境因素：1.温度；2.湿度；3.日光（C错）；4.空气（E错）；5.霉菌（D错）；6.虫害（A错）；7.包装容器；8.贮存时间。